色谱柱理论计算公式n=5.54（tR/Wh/2）2中，Wh/2的含义是
A. 峰面积
B. 峰高
C. 保留时间
D. 峰宽
E. 半高峰宽

正确答案：E。半高峰宽